免疫效果评价指标是
A. 疫苗效果指数
B. 抗体阳转率
C. 建卡率
D. 四苗覆盖率
E. 接种率

正确答案：B。抗体阳转率